对高血压性脑出血，为了预防复发最重要的措施是
A. 控制血压、戒烟、限酒
B. 控制血压、少盐、少糖
C. 控制血压、少盐、少油
D. 控制血压、限烟、限酒
E. 控制血压、戒烟、戒酒

正确答案：E。控制血压、戒烟、戒酒